急惊风风热证的用方为
A. 银翘散
B. 羚角钩藤汤
C. 琥珀抱龙丸
D. 玉枢丹合保和丸
E. 黄连解毒汤合白头翁汤

正确答案：A。银翘散

解析：急惊风之风热证是由风邪郁而化热，热扰心肝二经所致，故治疗时应疏风清热，息风定惊，首选银翘散（A对）。羚角钩藤汤（B错）其功用为凉肝息风，增液舒筋，与紫雪丹合用，适用于急惊风之邪陷心肝证。琥珀抱龙丸（C错）其的功用为镇惊安神，适用于急惊风之暴受惊恐证。玉枢丹合保和丸（D错）适用于急惊风之痰湿惊风证。黄连解毒汤合白头翁汤（E错）适用于急惊风之湿热疫毒证。